毒物或其活性代谢产物经哪个途径排出后，仍具有特殊的毒理学意义
A. 呼吸道
B. 胃肠道
C. 肾脏
D. 乳腺
E. 汗腺

正确答案：D。乳腺